属于化学灭菌的是
A. 气体灭菌
B. 煮沸灭菌
C. 紫外线灭菌
D. 辐射灭菌
E. 流通蒸汽灭菌

正确答案：A。气体灭菌

解析：本题考查化学灭菌法。化学灭菌法系指用化学药品直接杀灭微生物的方法。包括气体灭菌法（A对）和药液灭菌法。煮沸灭菌（B错）、紫外线灭菌（C错）、辐射灭菌（D错）、流通蒸汽灭菌（E错）都属于物理灭菌法。